女性，30岁。便秘2年，近半月来大便时肛门疼痛，粪便表面及便纸上附有鲜血，其诊断最可能是
A. 内痔
B. 外痔
C. 直肠癌
D. 肛瘘
E. 肛裂

正确答案：E。肛裂

解析：患者长期便秘，排便时疼痛，便时出血（符合肛裂的典型症状），应诊断为肛裂（E对）。内痔（A错）的主要临床表现是出血和脱出。外痔（B错）的主要临床表现是肛门不适、潮湿不洁。患者无直肠刺激症状，不应诊断为直肠癌（C错）。肛瘘（D错）的典型表现为瘘管外口反复排出脓性分泌物。